某低龄儿童，喜挑食，生长发育迟缓，在黑暗环境中适应能力下降。其最可能缺乏的维生素是哪种
A. 维生素A
B. B族维生素
C. 维生素C
D. 维生素D
E. 维生素E

正确答案：A。维生素A